固定-可摘联合桥
A. 可以自行摘戴的固定桥
B. 被称为完全固定桥
C. 固位力主要来自粘接材料的粘结力的固定桥
D. 一端的固定体为固定连接，另一端的固位体为活动连接的固定桥
E. 以各种骨内种植体作为固定桥的支持和固位端制成的固定桥

正确答案：A。可以自行摘戴的固定桥

解析：固定-可摘联合桥：其支持形式与双端固定桥相同，义齿承受（牙合）力由基牙承担，但不同之处是该型固定桥可自行摘戴。义齿固位依靠固位体的内外冠之间产生的摩擦力或者磁性固位体的吸力等产生固位。掌握“固定桥的组成和分类”知识点。